小儿生后体格发育最快的时期在
A. 胎儿期
B. 婴儿期
C. 幼儿期
D. 学龄前期
E. 学龄期

正确答案：B。婴儿期

解析：本题考查体格生长发育的相关内容。小儿出生后生长发育最快的时期是婴儿期（B对ACDE错），是生后第一个生长高峰。